下列哪一点不是流行病学定义中的内涵
A. 研究对象是人群
B. 不仅研究疾病，而且研究健康状态
C. 重点研究疾病的症状及体征
D. 重点研究疾病及健康状态的分布及影响因素，并提出控制消灭疾病促进健康的策略及措施

正确答案：C。重点研究疾病的症状及体征

解析：本题考查流行病学定义的内涵。流行病学是研究人群（A对）中疾病与健康状况的分布及其影响因素（BD对），并研究防制疾病及促进健康的策略和措施的科学。流行病学研究的重点是人群的疾病与健康状况的分布，不是疾病的症状及体征（C错，为本题正确答案）。